镜下见肿物由许多牙样结构所组成，牙釉质、牙本质、牙骨质和牙髓的排列如同正常牙的排列方式，此为以上哪种疾病的病理表现
A. 多形性腺瘤
B. 混合性牙瘤
C. 良性黏膜类天疱疮
D. 组合性牙瘤
E. 根尖囊肿

正确答案：D。组合性牙瘤

解析：组合性牙瘤：镜下见肿物由许多牙样结构所组成，这些牙样结构虽然不同于正常牙，但牙釉质、牙本质、牙骨质和牙髓的排列如同正常牙的排列方式。掌握“牙瘤”知识点。